正常覆盖时，上颌切牙切缘到下颌切牙唇面的距离是
A. 3mm以内
B. 4mm左右
C. 5mm左右
D. 6mm左右
E. 7mm以上

正确答案：A。3mm以内

解析：本题考查覆盖。正常覆盖时，上颌切牙切缘到下颌切牙唇面的距离是3mm以内（A对）。上颌切牙盖过下颌前牙唇面的水平距离在3mm以内为正常覆盖。超过者为深覆盖。深覆盖可分为：Ⅰ°深覆盖，上颌切牙盖过的水平距离在3～5mm；Ⅱ°深覆盖，上颌切牙盖过的水平距离在5～7mm；Ⅲ°深覆盖，上颌切牙盖过的水平距离在7mm以上。